与泪腺分泌有关
A. 睫状神经节
B. 下颌下神经节
C. 翼腭神经节
D. 耳神经节
E. 星状神经节

正确答案：C。翼腭神经节

解析：睫状神经节（A错）支配瞳孔括约肌和瞳孔开大肌。下颌下神经节（B错）的分支分布于舌下腺和下颌下腺。翼腭神经节（C对）发出的分支分布于泪腺、鼻甲、腾的黏膜，司黏膜的一般感觉及控制腺体的分泌。耳神经节（D错）控制腮腺的分泌。星状神经节（E错）为颈胸神经节，分布于头颈和上肢的的血管、汗腺、竖毛肌等。